不同国家的学者在不同时间对本国人群作研究，均得出高盐饮食引起高血压，由此支持高盐饮食是影响高血压发生的危险因素这一推理运用了判定标准中的
A. 关联的特异性
B. 关联的时间顺序
C. 关联的可重复性
D. 关联的合理性

正确答案：C。关联的可重复性

解析：本题考查判定标准。结果的一致性指同类研究结果的一致性，一致性又叫可重复性，是不同时间、不同地点、不同人群、不同研究者使用类似的研究方法可重复获得相同或类似结果的可能性。不同国家学者在不同时间的研究均能得出相同的结果，在这一推理中运用了关联的可重复性（C对ABD错）。